下列筛检高血压高危人群的标准不正确的是
A. 重度吸烟
B. 口味偏咸
C. 经常饮高度白酒
D. 从不参加体育锻炼
E. 体重指数＜24kg/m²

正确答案：E。体重指数＜24kg/m²